女性，32岁。发热、多关节肿痛、双侧胸腔积液、尿蛋白（+）半年，实验室检查发现ANA（+），抗SSA（+），抗Sm（+）。首选治疗的药物是
A. 非甾体抗炎药
B. 镇痛剂，如：扑热息痛
C. 小剂量糖皮质激素
D. 免疫抑制剂
E. 糖皮质激素联合免疫抑制剂

正确答案：E。糖皮质激素联合免疫抑制剂

解析：育龄期女性患者（系统性红斑狼疮好发人群），出现发热、多关节肿痛，双侧胸腔积液及蛋白尿（系统性红斑狼疮常见表现），且ANA（抗核抗体）、抗Sm抗体（系统性红斑狼疮标记性抗体）及抗SSA抗体阳性，故最可能的诊断为系统性红斑狼疮患者出现双侧胸腔积液，说明处于病情活动期，应给予糖皮质激素快速控制病情活动，同时选用免疫抑制剂联合治疗（E对），有利于更好地控制SLE活动，保护重要脏器功能，减少复发，减少长期激素的需要量和副作用（P820）。非甾体抗炎药（A错）及镇痛药（B错）可针对发热及关节痛者辅助使用，为对症治疗，非首选。小剂量糖皮质激素（C错）用于缓解期后的长期维持治疗，不适用于急性期。单用免疫抑制剂（D错）起效较慢，不能快速控制病情发展。